下列除哪项外，均为音哑或失音的常见原因
A. 外感风寒
B. 外感风热
C. 痰浊壅肺
D. 心肺气虚
E. 肺肾阴虚

正确答案：D。心肺气虚

解析：心肺气虚时表现为声低懒言（D错，为本题正确答案）。语声嘶哑者为音哑，语而无声者为失音，古称为“喑”。两者病因病机基本相同，前者病轻，后者病重。新病音哑或失音者，多属实证，多因外感风寒（A对），或风热袭肺（B对），或痰湿壅肺（C对），肺气不宣，清肃失职所致，即所谓“金实不鸣”。久病音哑或失音者，多属虚证，多因各种原因导致肺肾阴虚（E对），阴虚火旺，津亏肺损，或肺气不足，发声无力，致声音难出，即所谓“金破不鸣”。